寒痰饮证的治则是
A. 燥湿
B. 清热
C. 温化
D. 润燥
E. 祛风

正确答案：C。温化

解析：寒痰饮证为外感寒湿，寒湿之邪侵袭肌表，困遏卫阳所致，饮为阴邪，遇寒则聚，得温则行，故治疗以温化为原则（C对）。